哪个不是“三管一灭”的内容
A. 管理水源
B. 管理粪便
C. 管理饮食
D. 消灭蚊子
E. 消灭苍蝇

正确答案：D。消灭蚊子